属于磷酸戊糖通路的酶是
A. 6-磷酸葡萄糖脱氢酶
B. 苹果酸脱氢酶
C. 丙酮酸脱氢酶
D. NADPH脱氢酶
E. 葡萄糖-6-磷酸酶

正确答案：A。6-磷酸葡萄糖脱氢酶

解析：属磷酸戊糖通路的酶是6-磷酸葡萄糖脱氢酶（A对），催化葡糖-6-磷酸氧化成6-磷酸葡糖酸内酯。苹果酸脱氢酶（P121）（B错）属三羧酸循环中的关键酶。丙酮酸脱氢酶（P118）（C错）属糖有氧氧化途径中的关键酶。NADPH脱氢酶（P176）（D错）主要存在于植物叶绿体中，与人的糖代谢无关。葡萄糖-6-磷酸酶（P134）（E错）属糖异生中的关键酶。